心动周期中，心室血液充盈主要是由于
A. 血液的重力作用
B. 心房收缩的挤压作用
C. 胸内负压的作用
D. 心室舒张的抽吸
E. 胸廓的扩张

正确答案：D。心室舒张的抽吸